女，25岁。进食生冷食物后上腹痛。恶心剧烈呕吐，初为胃内容物，后为少量新鲜血。引起呕血最可能的原因是
A. 贲门黏膜撕裂
B. 十二指肠溃疡合并出血
C. 反流性食管炎合并出血
D. 急性糜烂性出血性胃炎
E. 应激性溃疡

正确答案：A。贲门黏膜撕裂

解析：贲门黏膜撕裂可由剧烈呕吐导致腹内压和胃内压突然增高引起，以上消化道出血为主，常为鲜血。患者进食生冷食物后，出现剧烈呕吐和呕少量鲜血，符合贲门黏膜撕裂，因此呕血最可能的原因是贲门粘膜撕裂（A对）。十二指肠溃疡虽然是上消化道出血最常见的原因，但患者并没有十二指肠溃疡病史，所以并不能说明呕血的原因是十二指肠溃疡合并出血（B错）。反流性食管炎以反酸、烧心为主，患者并没有出现相关症状，因此不是反流性食管炎合并出血（C错）。急性糜烂性出血性胃炎常见于服用非甾体抗炎药，也可见于严重创伤、手术等，患者并没有相关病史，因此不能说明是急性糜烂性出血性胃炎（D错）。应激性溃疡多与休克，、复合性创伤、严重烧伤、严重脑外伤等有关，与患者症状不相符（E错）。